某患者面部遭受外力打击后，未形成开放性创口，局部肿胀、疼痛和皮下淤血，X线检查未见颌骨骨折。临床诊断为
A. 撕裂伤
B. 烧伤
C. 挫伤
D. 擦伤
E. 撕脱伤

正确答案：C。挫伤

解析：挫伤：是皮下及深部组织遭受力的挤压损伤而无开放创口。伤处的小血管和淋巴管破裂，常有组织内渗血而形成瘀斑，甚至发生血肿。主要特点是局部皮肤变色、肿胀和疼痛。挫伤的治疗主要是止血、止痛、预防感染、促进血肿吸收和恢复功能。早期可用冷敷和加压包扎止血。如血肿较大，可在无菌条件下，用粗针头将淤血抽出，然后加压包扎。已形成血肿者，2天后可用热敷、理疗或中药外敷，促进血肿吸收及消散。血肿如有感染，应予切开，清除脓液及腐败血凝块，建立引流。并应用抗生素控制感染。掌握“口腔颌面部软组织创伤”知识点。